位于椎管前壁的韧带是
A. 前纵韧带
B. 后纵韧带
C. 弓间韧带
D. 骶棘韧带
E. 棘上韧带

正确答案：B。后纵韧带

解析：后纵韧带位于椎管的前壁（B对），起自第2颈椎，沿椎体的后壁，连结椎间盘，止于骰骨。